根据《药品经营质量管理规范》，测量范围在0℃～40℃之间的温湿度监测系统，测量设备的温度最大允许误差为
A. ±2.0℃
B. ±0.5℃
C. ±0.10℃
D. ±1.0℃

正确答案：B。±0.5℃

解析：本题考查的是药品经营质量管理规范的温湿度监测系统。测量范围在0℃～40℃之间的温湿度监测系统，测量设备的温度最大允许误差为±0.5℃（B对）。系统温湿度测量设备的最大允许误差应符合要求。测量范围在0℃～40℃之间，温度的最大允许误差为±0.5℃（B对）；测量范围在-25℃～0℃之间，温度的最大允许误差为±1.0℃（D错）。